除重病区外，地方性甲状腺肿患病率两性差异最大的年龄为
A. 1～10岁
B. 15～20岁
C. 25～35岁
D. 40岁以后
E. 50岁以后

正确答案：B。15～20岁

解析：本题考查除重病区外，地方性甲状腺肿患病率两性差异最大的年龄。地方性甲状腺肿是一种主要由于地区性环境缺碘引起的地方病，是碘缺乏病的主要表现形式之一，其主要症状是甲状腺肿大。除重病区外，地方性甲状腺肿患病率两性差异最大的年龄为15～20岁（B对ACDE错）。